不符合药物代谢中的结合反应特点的是
A. 在酶催化下进行
B. 无需酶的催化即可进行
C. 形成水溶性代谢物，有利于排泄
D. 形成共价键的过程
E. 形成极性更大的化合物

正确答案：B。无需酶的催化即可进行

解析：本题考查药物化学结构与第Ⅱ相生物转化的规律。药物代谢中的结合反应是药物的第二相转化反应，此过程需要酶的催化（A对B错，为本题正确答案），第二相生物转化反应包括 1.与葡萄糖醛酸的结合反应、2.与硫酸的结合反应、3.与氨基酸的结合反应、4.与谷胱甘肽的结合反应、5.乙酰化结合反应、6.甲基化结合反应，生成共价键（D对），形成极性更大的水溶性代谢物，有利于排泄（CE对）。